反对安乐死的下述理由中，最有可能得不到伦理支持的是
A. 安乐死是变相杀人，与医务人员救死扶伤的神圣职责背道而驰
B. 生死有命，个人不能自作主张
C. 医生不可杀人
D. 人有生的权利，任何时候都不能主动促死，否则有违人道
E. 不可逆病情诊断难以把握，而且由此会使病人失去自愈等机会.

正确答案：B。生死有命，个人不能自作主张

解析：B死生有命。这是唯心的话，自然不对。掌握“安乐死与死亡伦理”知识点。